药品零售企业的下列经营行为中，正确的是
A. 将本企业购进的药品转售给其他药品经营企业
B. 在“广交会”上销售其现货药品
C. 销售所在市某公立医院配制的滴耳液
D. 在开展社区健康宣传活动中销售少量非处方药品
E. 药师不在岗时，停止向患者销售处方药

正确答案：E。药师不在岗时，停止向患者销售处方药

解析：本题考查执业药师的职责。药品零售企业的下列经营行为中，正确的是药师不在岗时，停止向患者销售处方药（E对）。《国家药监局人力资源社会保障部关于印发执业药师职业资格制度规定和执业药师职业资格考试实施办法的通知》第四章职责第二十一条：药品零售企业应当在醒目位置公示《执业药师注册证》，并对在岗执业的执业药师挂牌明示。执业药师不在岗时，应当以醒目方式公示，并停止销售处方药和甲类非处方药。执业药师执业时应当按照有关规定佩戴工作牌。药品零售是指将药品直接销售给个人消费者的药品经营方式（A错）。药品批发企业不得以展销会、博览会、交易会、订货会、产品宣传会等方式现货销售药品或赠送药品（BD错）。药品零售企业不得经营的药品种类：药品零售企业不得经营的药品：麻醉药品、放射性药品、第一类精神药品、终止妊娠药品（包括含有“米非司酮”成分的所有药品制剂）、蛋白同化制剂、肽类激素（胰岛素除外）、药品类易制毒化学品、疫苗，以及我国法律法规规定的其他禁止零售的药品。药品零售企业也不得经营中药配方颗粒、医疗机构制剂（C错）。